女，70岁。外阴、阴道灼热感4天。妇科检查：阴道粘膜有散在出血点，阴道内少许分泌物，呈淡黄色，该患者首先考虑的诊断为
A. 萎缩性阴道炎
B. 淋菌性阴道炎
C. 细菌性阴道病
D. 外阴阴道念珠菌病
E. 滴虫阴道炎

正确答案：A。萎缩性阴道炎

解析：该患者为老年女性（萎缩性阴道炎常见于自然绝经或人工绝经后妇女），外阴、阴道灼热感4天（主要症状为外阴灼热不适），阴道黏膜有散在出血点，分泌物少许，呈淡黄色（阴道分泌物稀薄，呈淡黄色，妇检可见阴道黏膜充血，有散在小出血点或点状出血斑），故该患者首先考虑的诊断为萎缩性阴道炎（A对）。淋菌性阴道炎（P101）（B错）主要有阴道脓性分泌物增多，外阴瘙痒或灼热，偶有下腹痛。妇检可见宫颈水肿、充血等宫颈炎表现，细菌性阴道病（P251）（C错）阴道黏膜无充血的炎症表现，分泌物呈灰白色，均匀一致稀薄状。外阴阴道念珠菌病（P249）（D错）主要表现为外阴瘙痒、灼痛，分泌物特征为白色稠厚呈凝乳或豆腐渣样。滴虫阴道炎（P247）（E错）严重者，阴道黏膜有散在出血点，甚至宫颈有出血斑点，形成“草莓样”宫颈，但其分泌物特点为稀薄脓性、黄绿色、泡沫状、有臭味。